心理治疗人员被县级以上人民政府卫生行政部门责令改正，给予警告的情形是
A. 从事心理治疗的人员在医疗机构以外开展心理治疗活动的
B. 专门从事心理治疗的人员从事精神障碍的诊断的
C. 专门从事心理治疗的人员为精神障碍患者开具处方
D. 专门从事心理治疗的人员为精神障碍患者提供外科治疗的
E. 以上说法均正确

正确答案：E。以上说法均正确

解析：本题考查心理咨询、心理治疗人员的法律责任。心理治疗人员被县级以上人民政府卫生行政部门责令改正，给予警告的情形是从事心理治疗的人员在医疗机构以外开展心理治疗活动的；专门从事心理治疗的人员从事精神障碍的诊断的；专门从事心理治疗的人员为精神障碍患者开具处方；专门从事心理治疗的人员为精神障碍患者提供外科治疗的，所以以上说法均正确（E对）。心理咨询人员有下列情形之一的，县级以上人民政府卫生行政部门、工商行政管理部门依据各自职责责令改正，给予警告，并处5000元以上1万元以下罚款，有违法所得的，没收违法所得；造成严重后果的，责令暂停6个月以上1年以下执业活动，直至吊销执业证书或者营业执照：①心理咨询人员从事心理治疗或者精神障碍的诊断、治疗的；②从事心理治疗的人员在医疗机构以外开展心理治疗活动的（A对）；③专门从事心理治疗的人员从事精神障碍的诊断的（B对）；④专门从事心理治疗的人员为精神障碍患者开具处方（C对）或者提供外科治疗的（D对）。